形容细菌大小常用长度单位是
A. Cm
B. mm
C. μm
D. nm
E. pm

正确答案：C。μm

解析：本题考查细菌的大小与形态。形容细菌大小常用长度单位是μm（C对）。观察细菌最常用的仪器是光学显微镜，其大小可以用测微尺在显微镜下测量，一般以微米（um）为单位。